男性患者59岁，上牙列缺失，右下8健康，近中舌侧倾斜，牙槽嵴丰满，上颌散在骨尖，颌间距离正常。戴用义齿一周后需复诊调牙合的原因是义齿下沉。病人复诊时反映戴牙恶心，可能是什么原因
A. 后牙早接触
B. 上颌后缘过长
C. 义齿固位不好
D. 下颌后牙排列过于靠舌侧
E. 都对

正确答案：B。上颌后缘过长

解析：本题考查病人戴牙恶心的原因。全口义齿在初戴时病人常反应戴牙恶心，常见的原因是由于上颌义齿后缘伸展过长（B对）或义齿基托后缘与口腔不密合，刺激软腭以及唾液刺激黏膜而引起恶心。后牙早接触（A错）会导致垂直距离过高、固位不良、义齿前后翘动、牙槽嵴黏膜压痛等。义齿固位不好（C错）容易导致义齿松动脱落。下颌后牙排列过于靠舌侧（D错）容易出现发音障碍并且影响舌体活动，导致义齿不稳定。